把五脏、六腑、形体、官窍等全身组织器官联系成有机整体的是
A. 精
B. 经络
C. 气
D. 血
E. 津液

正确答案：B。经络

解析：本题考查的是五脏一体观。把五脏、六腑、形体、官窍等全身组织器官联系成有机整体的是经络（B对）。五脏一体观：人体以五脏为中心，配合六腑、五体、五官、九窍、四肢百骸等，通过经络系统的联系以及精（A错）、气（C错）、血（D错）、津液（E错）的作用，构成了心、肝、脾、肺、肾五个生理系统。心、肝、脾、肺、肾五个生理系统之间，具有结构的完整性和功能的统一性，相互促进，相互制约，共同维持生命活动的正常进行。这种以五脏为中心的结构与功能相统一的观点，称为“五脏一体观”。